脂肪酸β-氧化发生部位
A. 胞液
B. 线粒体
C. 内质网
D. 胞液和线粒体
E. 胞液和内质网

正确答案：D。胞液和线粒体

解析：脂肪酸的β-氧化方式是脂肪酸氧化分解的主要方式，主要过程如下：脂肪酸的活化－脂酰CoA的生成；脂肪动员的主要产物是游离脂肪酸。它在氧化分解前需先在胞浆中的内质网或线粒体外膜上活化成活泼的脂酰CoA才能进一步转变。催化此反应的酶为脂酰CoA合成酶，反应需消耗ATP。掌握“脂肪的分解代谢”知识点。